急性失血所致病人休克时，提示失血量至少已达总血量的
A. 10%
B. 10%～20%
C. 20%～40%
D. ＞40%
E. 以上都不是

正确答案：C。20%～40%

解析：本题考查失血性休克。急性失血所致病人休克时，提示失血量至少已达总血量的20%～40%（C对）。失血性休克在外科休克中很常见。多见于大血管破裂、腹部损伤引起的肝、脾破裂、胃、十二指肠出血、门静脉高压症所致的食管、胃底曲张静脉破裂出血等。大量血液丢失，导致有效循环血量的不足。通常在迅速失血超过全身总血量的20%时，即发生休克。